张某没有上过任何层次的医学专业的学校。但他仍有资格参加执业医师资格或执业助理医师资格考试，张某必定具有执业医师法规定的以下情形之一。除了
A. 以师承方式学习传统医学满三年，经县级以上卫生行政部门确定的传统医学专业组织考核合格并推荐
B. 以师承方式学习传统医学满三年，经医疗、预防、保健机构考核合格并推荐
C. 以师承方式学习传统医学满三年，经医疗、预防、保健机构推荐
D. 经多年实践医术确有专长，经县以上卫生行政部门确定的传统医学专业组织考核合格并推荐
E. 经多年实践医术确有专长，经医疗、预防、保健机构考核合格并推荐

正确答案：C。以师承方式学习传统医学满三年，经医疗、预防、保健机构推荐